初产妇，25岁。妊娠40⁺⁵周，规律宫缩16小时，胎膜已破，宫缩弱，宫口开大5cm，S﹣1，胎心180次/min，宫缩时觉肛门坠胀。本例正确的处理是
A. 左侧卧位、吸氧
B. 静脉滴注缩宫素
C. 立即行剖宫产术
D. 肌内注射哌替啶100mg
E. 继续观察1小时后再决定分娩方式

正确答案：C。立即行剖宫产术